患者。男，32岁，右上后牙持续胀痛不能咬物，无冷热刺激痛病史。检查发现右上第二磨牙远中牙龈红肿，探诊出血。第三磨牙伸长无对颌牙。初步诊断
A. 冠周炎
B. 急性龈乳头炎
C. 急性牙周脓肿
D. 龈缘炎
E. （牙合）创伤

正确答案：B。急性龈乳头炎

解析：本题考查急性龈乳头炎的诊断。患者。男，右上后牙持续胀痛不能咬物（有胀痛），无冷热刺激痛病史（无牙髓炎）。检查发现右上第二磨牙远中牙龈红肿（牙龈肿胀），探诊出血，第三磨牙伸长无对颌牙。综合考虑初步诊断为急性龈乳头炎（B对）。龈乳头发红肿胀，探触和吸吮时易出血，有自发性的胀痛和明显的探触痛。有时疼痛可表现为明显的自发痛和中等程度的冷热刺激痛，易与牙髓炎混淆。检查可见龈乳头鲜红肿胀，探触痛明显，易出血，有时局部可查到刺激物，牙可有轻度叩痛，这是因为龈乳头下方的牙周膜也有炎症和水肿。冠周炎（A错）为发生于智齿牙冠周围软组织的炎症。急性牙周脓肿（C错）的临床表现应为患牙牙龈上形成圆形突起，色红、水肿、表面光亮。龈缘炎（D错）一般不会有胀痛，且游离龈及龈乳头多会变成深红或暗红色。由于第三磨牙伸长无对颌牙，故排除（牙合）创伤（E错）。